男，2岁。1个月来食欲减退、消瘦伴乏力，近2周低热、盗汗、干咳。2个月前曾患麻疹。查体：消瘦，未见瘢痕，颈部可触及数个肿大淋巴结，质硬，无明显压痛，心脏检查未见异常，右肺可闻及少许干湿啰音，肝肋下3cm，脾不大。最可能的诊断是
A. 原发型肺结核
B. 支气管肺炎
C. 支气管淋巴结核
D. 浸润型肺结核
E. 颈部淋巴结核+支气管淋巴结核

正确答案：A。原发型肺结核

解析：患儿食欲减退，消瘦乏力，低热盗汗，为结核病的全身中毒症状。2个月曾患麻疹（有急性传染病史，可导致免疫力暂时降低），查体颈部有数个肿大质硬无压痛的淋巴结，肝肋下3cm，综上考虑诊断为肺结核。由于小儿以原发型肺结核多见，成人以浸润型肺结核多见（D错），故本例应诊断为原发性肺结核（A对）。支气管肺炎无低热盗汗等结核中毒症状（B错）。支气管淋巴结核为原发型肺结核的表现形式之一，原发性肺结核包括原发综合征和支气管淋巴结核（CE错）。